某女，30岁。素体强健。近日，因着衣不慎而感风寒,导致感冒咳嗽，症见发热、恶寒、咳嗽、鼻塞流涕、头痛、无汗、肢体酸痛。证属风寒束表、肺气不宣宜选用的成药是
A. 蠲哮片
B. 强力枇杷露
C. 桂龙咳喘宁胶囊
D. 止嗽定喘口服液
E. 通宣理肺丸

正确答案：E。通宣理肺丸

解析：本题考查通宣理肺丸的主治。证属风寒束表、肺气不宣宜选用的成药是通宣理肺丸（E对）。通宣理肺丸【主治】风寒束表、肺气不宣所致的感冒咳嗽，症见发热、恶寒、咳嗽、鼻塞流涕、头痛、无汗、肢体酸痛。蠲哮片（A错）【主治】肺气亏虚，肺失宣降所致的虚劳久嗽、气短喘促。强力枇杷露（B错）【主治】痰热伤肺所致的咳嗽经久不愈、痰少而黄或干咳无痰；急、慢性支气管炎见上述证候者。桂龙咳喘宁胶囊（C错）【主治】外感风寒，痰湿内阻引起的咳嗽、气喘、痰涎壅盛；急、慢性支气管炎见上述证候者。止嗽定喘口服液（D错）【主治】表寒里热，身热口渴，咳嗽痰盛，喘促气逆，胸膈满闷；急性支气管炎见上述证候者。